近年来输血后肝炎主要由哪种病毒引起
A. 甲型肝炎病毒
B. 乙型肝炎病毒
C. 丙型肝炎病毒
D. 戊型肝炎病毒
E. 丁型肝炎病毒

正确答案：C。丙型肝炎病毒

解析：传播途径甲型、戊型肝炎以粪-口传播为主；乙型肝炎主要通过血液和血制品传播、接触（日常生活密切接触和性接触）传播和母婴传播。丙型肝炎亦主要经血液和血制品传播。近年来输血后肝炎主要由丙型肝炎病毒引起。掌握“病毒性肝炎”知识点。